天然土壤中存在的致病菌为
A. 肠道致病菌
B. 大肠杆菌
C. 破伤风梭菌及肉毒梭菌等
D. 金黄色葡萄球菌
E. 噬菌体

正确答案：C。破伤风梭菌及肉毒梭菌等

解析：本题考查天然土壤中存在的致病菌。天然土壤中常含有破伤风梭菌和肉毒梭菌（C对ABDE错），人接触土壤而引起破伤风和肉毒中毒。这两种病菌抵抗力很强，在土壤中能长期存活。